患者，女性，65岁，因阵发性胸闷8年，持续胸痛8小时收入院。入院时血压为150/90mmHg，诊断急性前壁心肌梗死。此时最具特征性的实验室改变是
A. 血清LDH上升
B. 血清GOT上升
C. 血清GPT上升
D. 血清CK-MB上升
E. 血清肌红蛋白下降

正确答案：D。血清CK-MB上升

解析：血清CK-MB（肌酸磷酸激酶同工酶）在心肌梗死起病后4小时内增高，16～24小时达高峰，3～4天恢复正常，其增高的程度可较准确的反映梗死的范围，本例患者心肌梗死发作持续胸痛8小时，故此时最具特征性的实验室改变是血清CK-MB上升（D对）。血清LDH（A错）即乳酸脱氢酶，血清GOT（AST）（B错）即天冬氨酸氨基转移酶，两者由于特异性及敏感性均远不如CK-MB等心肌坏死标记物，目前已不再用于诊断急性心肌梗死。血清GPT（C错）即丙氨酸氨基转移酶（ALT），主要存在于肝细胞内，其升高多见于肝细胞损伤。血清肌红蛋白（E错）心肌梗死起病后2小时内升高，12小时内达高峰，本例患者心肌梗死发作持续胸痛8小时，故此时血清肌红蛋白应该升高而不是下降。